加工时晒干或用硫黄熏，使果皮漂白的是
A. 砂仁
B. 豆蔻
C. 二者均是
D. 二者均不是

正确答案：D。二者均不是

解析：本题考查的是砂仁与豆蔻的采收加工。砂仁与豆蔻加工时无需漂白果皮（D对）。砂仁（A错）：【采收加工】夏、秋二季果实成熟时采收，晒干或低温干燥。豆蔻（B错）：【采收加工】10～12月间采收未完全成熟果实，干燥后除去顶端的花萼及基部的果柄，晒干。